可引起蛋白尿和急性肾衰竭的药品是
A. 人促红素
B. 甲基多巴
C. 利多卡因
D. 阿米卡星
E. 吡罗昔康

正确答案：D。阿米卡星

解析：本题考查药物不良反应。阿米卡星（D对）具有肾毒性，主要损害近端肾小管，可出现蛋白尿、管型尿，继而出现血尿、尿量减少或增多，进而发生氮质血症、肾功能减退、排钾增多等。人促红素（A错）可引起纯红细胞再生障碍性贫血。甲基多巴（B错）不良反应较常见的有水钠猪留所致的下肢浮肿、口干。较少见的有药物热或嗜酸性粒细胞增多、肝功能变化（可能属免疫性或过敏性）、精神改变（抑郁或焦虑、梦呓、失眠）、性功能减低、腹泻、乳房增大、恶心、呕吐、晕倒。偶见的有加重心绞痛和心力衰竭。利多卡因（C错）中枢神经系统症状有嗜睡、眩晕，过量注射引起语言障碍、惊厥甚至呼吸抑制；剂量过大可引起窦性过缓、房室传导阻滞等心脏毒性。眼球震颤是利多卡因中毒的早期信号。吡罗昔康（E错）为速效、强效、长效非甾体抗炎药，剂量过大或长期服用可致消化性溃疡、出血。